罹患率的计算公式是
A. （观察期间病例数/同期平均人口数）✕100%
B. （一年内新发病例数/同年暴露人口数）✕100%
C. （观察期间新病例数/同期平均人口数）✕100%
D. （观察期间新病例数/同期暴露人口数）✕100%
E. （观察期间新旧病例数/同期平均人口数）✕100%

正确答案：D。（观察期间新病例数/同期暴露人口数）✕100%